影响药物透皮吸收的因素有
A. 药物的分子量
B. 基质的特性与亲和力
C. 药物的颜色
D. 透皮吸收促进剂
E. 皮肤渗透性

正确答案：A、B、D、E。药物的分子量；基质的特性与亲和力；透皮吸收促进剂；皮肤渗透性

解析：本题考查影响药物透皮吸收的因素。影响药物透皮吸收的因素有：①皮肤的渗透性（E对）；②药物的分子量（A对）；③基质的性质（B对）；④透皮吸收促进剂（D对）；药物的颜色（C错）与药物透皮吸收无关。